患者，女，27岁，已婚，每天测基础体温，月经已过10天，高温相持续34周不见下降，最大可能的诊断为
A. 闭经
B. 卵巢近期有感染
C. 早期妊娠
D. 月经即将来潮
E. 月经失调

正确答案：C。早期妊娠

解析：患者为生育年龄妇女，平素月经周期规律，一旦月经过期10天或以上，应首先考虑早期妊娠的可能，再根据患者高温相持续3、4周不见下降，其早期妊娠的可能性更大（C对）。正常月经周期建立后月经停止6个月以上，或按自身原有月经周期计算停止3个月经周期以上者为闭经（A错）。卵巢感染常常会引起下腹部一侧，或者是两侧出现持续性的疼痛表现，同房或者是饮食辛辣刺激以后，疼痛会明显加重。由于炎症的刺激，还可能导致炎性渗出物流入盆腔而形成盆腔积液，此时可能还会引起下腹部和肛门的明显坠胀表现。感染严重的时候还可能会形成卵巢脓肿，而出现发热，甚至是寒战高热的表现（B错）。部分女子在经前或经期可有轻微的小腹胀、腰酸、乳胀，或情绪不稳定，经后自然缓解（D错）。患者就诊时仅有一次月经后期，无法确诊为月经失调（E错）。